可分泌肾素的结构是
A. 致密斑
B. 系膜细胞
C. 间质细胞
D. 颗粒细胞
E. 感受器细胞

正确答案：D。颗粒细胞